待检产品
A. 绿色
B. 红色
C. 蓝色
D. 白色
E. 黄色

正确答案：E。黄色

解析：本题考查药品储存要求。待检产品为黄色（E对）。在人工作业的库房储存药品，按质量状态实行色标管理：合格药品为绿色（A错），不合格药品为红色（B错），待确定药品为黄色。